注射乙肝疫苗后阳性的标志是
A. 抗-HBe(+)
B. HBcAg(+)
C. 抗-HBs(+)
D. HBsAg(+)
E. 抗-HBc(+)

正确答案：C。抗-HBs(+)

解析：注射乙肝疫苗后阳性的标志是抗-HBs(+)（C对），抗HBs为保护性抗体，阳性表示对HBV有免疫力。抗-HBe(+)（A错）表示HBV复制多处于静止状态。HBcAg(+)（B错）表示表示HBV处于复制状态。HBsAg(+)（D错）反应现症HBV感染。抗-HBc(+)（E错）表示HBV现症感染或既往感染。